用亚硝酸钠滴定法测磺胺嘧啶药物含量时，指示剂终点的方法为
A. 淀粉指示剂指示终点
B. 结晶紫指示剂指示终点
C. 酚酞指示剂指示终点
D. 永停滴定法
E. 滴定剂自身指示剂

正确答案：D。永停滴定法

解析：本题考查亚硝酸钠滴定法。亚硝酸钠滴定法是亚硝酸钠在盐酸存在条件下与具有芳伯氨基化合物发生重氮化反应，定量生成重氮盐的方法。《中国药典》中记载使用永停滴定法指示终点（D对）。淀粉指示剂（A错）是碘量法所用指示终点；结晶紫（B错）是非水碱量法所用指示终点；酚酞指示剂（C错）是酸碱滴定法所用指示终点。